男，40岁。体重60kg，右上肢肩关节以下右下肢膝关节以下烧伤，深度为浅Ⅱ度至深Ⅱ度，右足部烧伤深度为Ⅲ度。该患者第一个24小时的补液量应为
A. 2500ml
B. 1700ml
C. 2000ml
D. 3700ml
E. 4000ml

正确答案：D。3700ml

解析：患者烧伤面积为19%。计算：19（烧伤百分比）×60（体重）×1.5（胶体与电解质液）=1710ml，再加上基础水分2000ml，共计3710ml，约为3700ml（D对）。